急性红斑型念珠菌口炎的临床表现是
A. 病损区黏膜充血，有散在的色白如雪的柔软小斑点
B. 病损区黏膜表现为结节状或颗粒状增生，或为固着紧密的白色角质斑块
C. 病损区黏膜呈亮红色水肿，或见斑点状假膜
D. 病损区黏膜充血糜烂，舌背乳头成团块萎缩，周围舌苔增厚
E. 病损区黏膜出现珠光白色网纹伴充血

正确答案：D。病损区黏膜充血糜烂，舌背乳头成团块萎缩，周围舌苔增厚

解析：本题考查口腔念珠菌病。急性红斑型念珠菌口炎的临床表现是病损区黏膜充血糜烂，舌背乳头成团块萎缩，周围舌苔增厚（D对）。1.急性红斑型念珠菌性口炎：临床表现为黏膜上出现外形弥散的红斑，以舌黏膜多见，严重时舌背黏膜呈鲜红色并有舌乳头萎缩，双颊、上腭及口角也可有红色斑块。黏膜红斑是由于上皮萎缩加上黏膜充血所致，因此，近年来有学者认为该型以红斑型取代以前命名的萎缩型较为合理。若继发于假膜型，则可见假膜。自觉症状为口干、味觉异常、疼痛及烧灼感。2.急性假膜型念珠菌性口炎：病损区黏膜充血，有散在的色白如雪的柔软小斑点（A错）。3.慢性增殖型念珠菌病：病损区黏膜表现为结节状或颗粒状增生，或为固着紧密的白色角质斑块（B错）。4.疱型扁平苔藓：病损区黏膜出现珠光白色网纹伴充血（E错）。